男，31岁。双侧臀区交替性疼痛9年余，间断腰痛6年，疼痛主要发生在夜间，伴有晨僵。近3周症状加重，有夜间痛醒现象。查体：腰部活动受限，右侧“4”字试验阳性。实验室检查：血沉24mm/h，HLAB27（+）。最恰当的治疗是
A. 骨科牵引
B. 骨科手术
C. 口服甲氨蝶呤
D. 休息理疗
E. 口服非甾体抗炎药

正确答案：E。口服非甾体抗炎药

解析：中年男性患者，双侧臀区交替性疼痛9年余，间断腰痛6年，疼痛主要发生在夜间，伴有晨僵。近3周症状加重，有夜间痛醒现象。查体：腰部活动受限，右侧“4”字试验阳性。实验室检查：血沉24mm/h（正常值成年男性0-15mm/h，成年女性0-20mm/h），HLAB27（+）。综合患者的症状、体征和辅助检查，初步诊断为强直性脊柱炎。最恰当的治疗是口服非甾体抗炎药（E对）解除疼痛。患者无畸形与骨折，无需骨科牵引（A错）。骨科手术（B错）有严重驼背或髋关节强直者。口服甲氨蝶呤（C错）适用于类风湿关节炎。休息理疗（D错）属于一般治疗。